奇静脉起于
A. 左腰升静脉
B. 附脐静脉
C. 半奇静脉
D. 右腰升静脉
E. 无

正确答案：D。右腰升静脉

解析：奇静脉起于右腰升静脉（D对）沿食管后方和胸主动脉右侧上行，至第4胸椎椎体高度向前勾绕右肺根上面，注入上腔静脉。